吩噻嗪类引起黄疸的常见原因是
A. 红细胞破坏
B. 肝细胞内微胆管阻塞
C. 肝细胞坏死
D. 胆红素结合障碍
E. 抑制肝药酶

正确答案：B。肝细胞内微胆管阻塞